乳牙患龋的最早年龄
A. 生后6个月
B. 1岁
C. 3岁
D. 6岁
E. 7～8岁

正确答案：A。生后6个月

解析：本题考查乳牙龋病。乳牙患龋的最早年龄是生后6个月（A对）。未萌出的牙不患龋，乳牙萌出后不久即可患龋，出生后6个月的婴儿上颌乳牙中切牙牙冠尚未完全萌出，远中唇面已患龋，这是乳牙患龋的最早年龄。与恒牙相比，在牙齿萌出后，乳牙龋病的发生较早。有关我国乳牙患龋率的报道，均显示1岁左右起即直线上升，7、8岁时达高峰，此后由于乳、恒牙的替换，恒牙的陆续萌出，乳牙的患龋率下降。